有关HAV的抵抗力，下列说法正确的是
A. 在粪便和污染的食物中可存活数周
B. 可在﹣20℃条件下存活数年但失去传染性
C. 100℃5min难以完全灭活
D. 对紫外线不敏感
E. 对化学消毒剂的抵抗力弱于一般肠道病毒属病毒

正确答案：A。在粪便和污染的食物中可存活数周

解析：本题考查HAV的抵抗力。HAV对热和酸碱有一定的耐受性，60℃1小时仍可存活，4℃下其抗原性和组织培养活性可保持1年，-20℃可存活数年并保持传染性（B错）。HAV在粪便和污染的食物中可存活数周（A对），在污水、泥土及毛蚶等水产品中能存活数月。HAV对紫外线、氯、甲醛等敏感（D错），对化学消毒剂的抵抗力强于一般肠道病毒属病毒（E错）。100℃煮沸5分钟可灭活病毒（C错）。